暴喜过度，临床常见哪些症状
A. 神无所归，虑无所定
B. 心悸失眠健忘多梦
C. 面红目赤，头胀痛
D. 精神不集中，甚则失神狂乱
E. 意志消沉，面色惨淡

正确答案：D。精神不集中，甚则失神狂乱

解析：本题考察七情内伤的致病特点。根据五行学说，五志分属五脏，心在志为喜，肝在志为怒，肺在志为忧，脾在志为思，肾在志为恐。七情太过可损伤相应之脏，心在志为喜，过喜则伤心，导致心气涣散，重者心气暴脱、神不守舍。临床可见临床可见精神不集中，神志失常，狂乱，或见心气暴脱的大汗淋漓，气息微弱，脉微欲绝等症（D对）。神无所归，虑无所定是过惊所致，如《素问·举痛论》说：“惊则心无所倚，神无所归，虑无所定，故气乱矣”（A错）。心悸失眠健忘多梦是心神不宁的表现，过度思虑或过惊皆能导致心悸失眠健忘多梦，而过喜则主要导致精神涣散，神志失常（B错）。面红目赤，头胀痛是过怒致肝气疏泄太过，气机上逆的表现（C错）。意志消沉，面色惨淡是过度悲忧伤肺，致肺气耗伤的表现（E错）。